女性，40岁。反复呕吐2天，因消化道溃疡幽门梗阻入院，测得血钾为3.2mmol/L，血钠为130mmol/L，血氯为70mmol/L。最可能的情况是
A. 低钾、高钠、低氯碱中毒
B. 低钾、低钠、低氯酸中毒
C. 低钾、低钠、高氯碱中毒
D. 低钾、低钠、低氯碱中毒
E. 低钾、高钠、高氯酸中毒

正确答案：D。低钾、低钠、低氯碱中毒

解析：患者因消化道溃疡幽门梗阻入院，反复呕吐造成胃液丧失过多，丧失大量的H⁺及Cl⁻，易导致碱中毒。原因：一方面肠液中的HCO₃⁻未能被胃液的H⁺所中和，HCO₃⁻被重吸收入血，使血浆HCO₃⁻增高；另一方面，胃液中Cl⁻的丢失使肾近曲小管的Cl⁻减少，为维持离子平衡，代偿性地重吸收HCO₃⁻增加，导致碱中毒。患者血钾为3.2mmol/L（正常血钾浓度为3.5～5.5mmol/L），血钠为130mmol/L（正常为135～145mmol/L），血氯为70mmol/L（正常为95～105mmol/L）均低于正常值，因此最可能的情况是低钾、低钠、低氯、碱中毒（D对）。